睾酮主要由哪种细胞分泌
A. 睾丸生精细胞
B. 睾丸支持细胞
C. 睾丸间质细胞
D. 曲细精管上皮细胞
E. 精原细胞

正确答案：C。睾丸间质细胞